在估计样本含量的公式N=K×Q/P中错误的解释是
A. N为受检人数
B. P为预期现患率
C. Q为1-P
D. K根据研究项目的允许误差大小而定
E. 允许误差为10%时，K=100

正确答案：E。允许误差为10%时，K=100

解析：N为受检人数，P为某病预期现患率，Q＝1-P，k值是根据研究项目的允许误差大小而确定，当允许误差为10%（0.1P）时，k＝400，当允许误差为15%（0.15P）时，k＝178，当允许误差为20%（0.2P）时，k＝100。掌握“口腔健康状况调查的样本含量及误差”知识点。